某男，38岁。内河航运船工，因腹痛、腹泻、乏力2天，于2003年10月7日入院。体温38.0℃，脱水不明显，无呕吐，水样便，无脓血，稍有粘液，有里急后重感。粪便常规每高倍镜视野：红细胞4个，白细胞8个，ALT正常。应首先考虑的是
A. 霍乱
B. 阿米巴痢疾
C. 细菌性痢疾
D. 急性肠炎
E. 病毒性肝炎

正确答案：C。细菌性痢疾

解析：本例患者秋季发病，体温38.0℃处于低热，腹痛、腹泻、乏力，脱水不明显，无呕吐，水样便，无脓血，稍有粘液，有里急后重感，本例患者粪便镜检见红细胞、白细胞，正常粪便中不见或偶见白细胞，无红细胞，故应首先考虑为细菌性痢疾（C对）。霍乱（A错）临床上为无痛性泻吐，以剧烈的腹泻继之以呕吐米泔水样物为特征，大便亦呈米泔水样，且不发热，多无腹痛，常很快出现脱水、酸中毒及周围循环衰竭；粪便培养霍乱弧菌阳性可确诊。阿米巴痢疾（B错）起病缓慢，全身症状较轻，无发热或仅有低热，主要表现为腹泻，每日3～10次，呈暗红色果酱样，常不伴有里急后重。急性肠炎（D错）主要表现为发热、腹痛、腹泻及黏液血便，少数可出现程度不等的神经病变，没有里急后重感。病毒性肝炎（E错）由多种肝炎病毒引起的传染病，以肝脏损害为主，常见症状有乏力、食欲减退、厌油腻、恶心、呕吐、有时腹痛、腹泻，ALT升高。